进行预防接种效果评价试验，在选择实验现场时以下哪条是错误的
A. 实验地区或单位的人口相对稳定
B. 实验研究的疾病在该地区有较高而稳定的发病率
C. 选择近期发生过该病流行的地区
D. 实验地区有较好的医疗卫生条件
E. 实验地区（单位）领导重视，群众愿意接受，有较好的协作配合的条件

正确答案：C。选择近期发生过该病流行的地区